属于磷酸二酯酶抑制剂的平喘药是
A. 沙美特罗
B. 孟鲁司特
C. 多索茶碱
D. 布地奈德
E. 噻托溴铵

正确答案：C。多索茶碱

解析：本题考查多索茶碱。属于磷酸二酯酶抑制剂的平喘药是多索茶碱（C对）。多索茶碱是茶碱衍生物，通过抑制平滑肌细胞内的磷酸二酯酶，使支气管平滑肌松弛。茶碱类药物属于磷酸二脂酶抑制剂，磷酸二脂酶抑制剂可以降低第二信使cAMP和cGMP的水解，提升细胞内cAMP和cGMP的浓度，用于哮喘的治疗。沙美特罗（A错）为长效β₂受体激动剂。β₂受体激动剂主要通过作用于呼吸道平滑肌和肥大细胞等细胞膜表面的β₂受体，松弛支气管平滑肌，缓解哮喘症状。孟鲁司特（B错）属于白三烯受体阻断剂，可通过拮抗半胱氨酸白三烯或多肽白三烯靶组织上的受体，缓解支气管的应激性和慢性炎症病变。布地奈德（D错）属于吸入性糖皮质激素，可以有效地控制气道炎症，减少哮喘发作次数，减轻发作的严重程度，减轻哮喘症状，降低病死率。噻托溴铵（E错）属于M胆碱受体阻断剂，可阻断节后迷走神经通路，降低迷走神经兴奋性，产生松弛支气管平滑肌作用。